早失后最易造成邻牙远中移位的乳牙是
A. 乳中切牙
B. 乳侧切牙
C. 乳尖牙
D. 第一乳磨牙
E. 第二乳磨牙

正确答案：C。乳尖牙

解析：本题考查乳牙早失-乳尖牙早失。早失后最易造成邻牙远中移位的乳牙是乳尖牙（C对）。上颌乳前牙早失易造成前牙反（牙合），下颌乳前牙早失易造成深覆（牙合）（AB错）。乳尖牙早失，恒切牙向远中倾斜移位，继替恒尖牙萌出障碍。第一恒磨牙在建（牙合）时会向近中移位，与第一乳磨牙早失相比，第二乳磨牙早失更容易造成邻牙近中移位（D错）。第二乳磨牙早失后，第一恒磨牙近中倾斜移位，后牙咬合关系紊乱，第二前磨牙萌出障碍（E错）。